双侧唇腭裂欲恢复牙弓形态和改善鼻畸形，应采用
A. 鼻畸形整复术
B. 腭裂整复术
C. 牙槽突植骨术
D. 正畸矫治器
E. 唇裂整复术

正确答案：D。正畸矫治器

解析：本题考查唇腭裂的修复方法。双侧唇腭裂欲恢复牙弓形态和改善鼻畸形，应采用正畸矫治器（D对）。正畸矫治器可恢复牙弓形态和改善鼻畸形；腭裂整复术（B错）最可能影响双侧唇腭裂患者上颌骨的发育。